四环素牙内脱色法说法错误的是
A. 一般临床效果很满意
B. 远期疗效可靠
C. 有效地去除原来结合在牙本质中的四环素含量
D. 缺点是使活髓牙变成死髓牙
E. 适用于迫切要求美观而又不伴有釉质缺陷者

正确答案：B。远期疗效可靠

解析：本题考查四环素牙内脱色法。四环素牙内脱色法说法错误的是远期疗效可靠（B错，为本题的正确答案）。内脱色法能有效地去除或改变原来结合在牙本质中的四环素含量（C对），荧光水平明显降低，临床效果非常满意（A对）。对因职业关系，迫切要求美观而又不伴有釉质缺陷者，可试用此法（E对）。它的缺点是使活髓牙变成死髓牙（D对）。近期疗效虽可靠，其远期疗效尚待观察。